乙酰胆碱舒张血管作用的机制
A. 激动血管内皮细胞N受体，促进NO释放
B. 激动血管内皮细胞M₃受体，促进NO释放
C. 直接松弛血管平滑肌
D. 激动血管平滑肌α受体
E. 激动血管平滑肌β受体

正确答案：B。激动血管内皮细胞M₃受体，促进NO释放

解析：乙酰胆碱舒张血管作用的机制激动血管内皮细胞M受体，促进NO释放（B对）。N受体是指位于神经节与神经肌肉接头的胆碱受体，激动N受体一般会引起骨骼肌的收缩（A错）。血管内皮生成的舒血管物质直接松弛血管平滑肌（C错）。肾上腺素激动血管平滑肌a受体，引起血管收缩（D错）。肾上腺素激动血管平滑肌β受体，引起血管舒张（E错）。